霍乱的主要传播途径是
A. 血液、体液、血液制品传播
B. 土壤传播
C. 飞沫传播
D. 水、食物、苍蝇传播
E. 吸血节肢动物传播

正确答案：D。水、食物、苍蝇传播

解析：霍乱患者和带菌者的粪便或呕吐物污染食物或水源后可引起霍乱暴发或流行（D对）。霍乱弧菌也可通过污染鱼、虾等水产品引起传播。日常的生活接触和苍蝇亦起传播作用。